首选用于治疗胃炎瘀阻胃络证的方剂是
A. 失笑散合丹参饮
B. 温胆汤合左金丸
C. 良附丸
D. 养胃汤加味
E. 香砂六君子汤

正确答案：A。失笑散合丹参饮

解析：瘀血阻于胃，故见胃脘疼痛如针刺，拒按；血液淤积不散，故见痛有定处；夜间阳气内藏，阴气用事，血行较缓，瘀阻更甚，故见疼痛入夜尤甚；瘀血阻络，故见便血；血行瘀滞，故见舌质暗红或紫暗，脉弦涩。方药：失笑散合丹参饮，可以化瘀通络，和胃止痛，治疗胃炎瘀阻胃络证（A对）。温胆汤合左金丸可以泻胆清热，降逆和胃（B错）。良附丸温胃理气，用于寒凝气滞，脘痛吐酸，胸腹胀满（C错）。养胃汤加味可以健脾养胃，以退寒热之功效。主治产后寒热往来，头痛无汗类疟者（D错）。香砂六君子汤可有疏补化痰之功效。主治气虚肿满，痰饮结聚，脾胃不和，变生诸证者（E错）。